患者男性，74岁。神情痴呆，表情淡漠，举止异常，面色晦滞，胸闷呕恶，舌苔白腻，脉滑。其病机是
A. 痰火扰心
B. 心血瘀阻
C. 痰迷心窍
D. 心脾两虚
E. 肾精亏虚

正确答案：C。痰迷心窍

解析：痰浊蒙蔽，心神不清，故见神情痴呆，意识模糊，甚则昏不知人；肝失疏泄，气郁生痰，蒙蔽心神，则见精神抑郁，表情淡漠，喃喃独语，举止失常；痰浊内盛，引动肝风，肝风夹痰，蒙蔽心神，故见突然昏仆，不省人事，口吐涎沫，喉中痰鸣；痰浊内阻，气血不畅，故面色晦暗；痰阻胸阳，胃失和降，则胸闷呕恶；舌苔厚腻，脉滑，均为痰浊内盛之证（C对）。痰火扰心（A错）易出现心烦心悸、口苦失眠、多梦易惊、面赤气粗、便秘尿赤甚至神志失常、胡言乱语、哭笑无常、狂躁妄动等症状。心血瘀阻（B错）易出现心胸憋闷疼痛，痛引肩背，并可循手少阴心经向左上肢放射，口唇爪甲青紫，舌质紫红或有瘀点、淤斑，脉涩或结等症状。心脾两虚（D错）多表现为心悸怔忡，失眠多梦，头晕健忘，纳差腹胀，神疲乏力，便溏出血等症状。肾精亏虚（E错）出现眩晕耳鸣，腰膝酸软，性功能减退，男子精少，女子天癸早竭，过早衰老，神疲健忘等临床表现。